质量调整生存年数是一个新的指标，它用
A. 权重系数来调整生存年数
B. 权重系数来调整期望寿命
C. 生命质量来调整期望寿命
D. 生命质量来调整生存年数
E. 生命数量来调整期望寿命

正确答案：D。生命质量来调整生存年数